应由省级药品监督管理部门批准并发给批准文号的是
A. 血液制品
B. 中药饮片
C. 化学原料药
D. 医院制剂
E. 中成药

正确答案：D。医院制剂

解析：本题考查的是医疗机构制剂注册制度。应由省级药品监督管理部门批准并发给批准文号的是医院制剂（D对）。医疗机构制剂注册制度：《药品管理法》规定，医疗机构配制的制剂，应当是本单位临床需要而市场上没有供应的品种，并应当经所在地省级药品监督管理部门批准；但是，法律对配制中药制剂另有规定的除外。获得《医疗机构制剂许可证》的医疗机构，如果要进行某种制剂的配制，还必须报送有关资料和样品，经所在地省级药品监督管理部门批准，发给制剂批准文号后，方可配制。